经皮肤和黏膜吸收中毒的救治措施，错误的是
A. 溶于水的毒物可用大量温水清洗被污染部位
B. 温水清洗皮肤时，特别需注意清除毛发中的毒物
C. 对由伤口进入局部的药物中毒，严禁用止血带结扎而阻滞毒物清除
D. 眼部被毒物污染时，应立即用清水冲洗，并滴入相应的中和剂
E. 不溶于水的毒物可用适当溶剂清洗

正确答案：C。对由伤口进入局部的药物中毒，严禁用止血带结扎而阻滞毒物清除

解析：本题考查经皮肤和黏膜吸收中毒的救治措施。经皮肤和黏膜吸收中毒的救治措施，错误的是对由伤口进入局部的药物中毒，严禁用止血带结扎而阻滞毒物清除（C错，为本题正确答案）。经皮肤和黏膜吸收中毒：①除去被污染的衣物，清除皮肤、黏膜上的毒物，用大量温水清洗被污染的皮肤与黏膜（A对），特别注意毛发和直接接触的部位（B对）；对不溶于水的毒物可用适当溶剂清洗（E对），如用10%乙醇或植物油冲洗酚类中毒，也可用适当的解毒剂加入水中冲洗；皮肤接触腐蚀性毒物者，冲洗时间要求达15～30分钟，并用适当的中和液或解毒液冲洗。②对由伤口进入或其他原因进入局部的药物中毒，要用止血带结扎，尽量减少毒物吸收，必要时行局部引流排毒。③眼内污染毒物时，必须立即用清水冲洗至少5分钟，并滴入相应的中和剂（D对）；对固体的腐蚀性毒物颗粒，要用眼科器械取出异物。